氨基酸的吸收通过
A. 甲硫氨酸循环
B. 嘌呤核苷酸循环
C. γ谷氨酰基循环
D. 鸟氨酸循环
E. 丙氨酸葡萄糖循环

正确答案：C。γ谷氨酰基循环